下列易被氧化的是
A. 维生素E
B. 维生素C
C. 两者均有
D. 两者均无

正确答案：C。两者均有

解析：本题考查易被氧化的药物。维生素C、维生素E两者（C对）均易被氧化。维生素C（B错）是强还原剂，其在酸性环境中稳定，遇空气中氧、热、光、碱性物质，特别是在氧化酶及痕量铜、铁等金属离子存在时，可促进其氧化破坏。维生素E（A错）对酸、热都很稳定，对碱不稳定，若在铁盐、铅盐或油脂酸败的条件下，会加速其氧化而被破坏，具有抗氧化的作用。故两者均易被氧化（D错）。